邪热内伏，反见四肢厥冷的病机特点是
A. 阳盛则阴病
B. 阴盛则寒
C. 阴损及阳
D. 阳虚则寒
E. 阳盛格阴

正确答案：E。阳盛格阴

解析：阳盛格阴是指阳气偏盛至极，壅遏于内，排斥阴气于外，而出现真热假寒证；邪热内伏，而反见四肢厥冷，其病机特点为内真热外假寒的阳盛格阴证（E对）。阳盛则阴病表现为实热证，兼有口渴、小便短少等（A错）。阴盛则寒表现为恶寒喜暖等实寒证（B错）。阴损及阳是阴虚的基础上又出现阳虚，形成以阴虚为主的阴阳两虚（C错）。阳虚则寒表现为畏寒肢冷，小便清长等虚寒证（D错）。